一外伤昏迷病员准备转送，不应采用的措施是
A. 采取俯卧位
B. 采取侧卧位
C. 采取俯卧位，额部垫高
D. 随时观察伤情变化，防止窒息和休克发生
E. 疑有颈椎损伤的伤员，颈下应放置小枕，头部左右两侧用小枕固定

正确答案：B。采取侧卧位

解析：本题考查口腔颌面部创伤急救。运送患者时应注意保持呼吸道通畅。昏迷患者可采用俯卧位（A对B错，B为本题正确答案），额部垫高（C对），使口鼻悬空，有利于唾液外流和防止舌后坠。一般的患者可采取侧卧位或头侧向一侧，避免血凝块及分泌物堆积在口咽部。运送途中，应随时观察伤情变化，防止窒息和休克发生（C对）。搬运疑有颈椎损伤的患者时，应多人同时搬运，一人稳定头部并加以牵引，其他人则以协调的力量将患者平直整体移动，抬到担架上，颈部应放置小枕，头部两侧加以固定，防止头的摆动（E对）。